肱动脉在肘部的摸脉位置是
A. 肱二头肌腱外侧
B. 肱二头肌腱内侧
C. 肱桡肌内侧
D. 肱三头肌腱内侧
E. 旋前圆肌内侧

正确答案：B。肱二头肌腱内侧

解析：肱二头肌腱内侧（B对）位置表浅，为肱动脉在肘部的摸脉位置。